口镜的作用是
A. 反映被检查部位的影像
B. 牵拉软组织
C. 聚集光线至被检查部位
D. 柄端用于牙齿叩诊检查
E. 以上各项均是

正确答案：E。以上各项均是

解析：本题考查口镜的作用。口镜的作用是反映被检查部位的影像；牵拉软组织；聚集光线至被检查部位；柄端用于牙齿叩诊检查，所以以上各项均是（E对，为本题正确答案）。口镜作为一种常用的牙科器械，其作用为：牵拉唇颊部软组织（B对）和推压舌体以便于直接观察欲检查部位；通过镜像反映被检查部位的影像（A对）可对上颌牙等难于直视部位进行观察；还可聚集光线至被检查部位（C对），增加欲检查部位的可视度，其柄端可也用于牙齿叩诊检查（D对）。